某男，36岁，患慢性肾炎5年，求中医诊治，希冀配服中成药，以缓解病情。症见浮肿，腰痛，乏力，小便不利，舌红，苔薄黄腻。证属湿热内蕴兼气虚。据此，医师处以肾炎四味片。1周后，患者再来就诊，诉云：药后发热，微恶风已，尿急、敁痛大减，眼睑浮肿也减轻，唯尿中仍有蛋白与潜血。据此，医师在原方上又加石韦、白茅根，再进7剂。并嘱其药后如病证恢复至首诊状态，可继服肾炎四味片。医师加用石韦与白茅根，里因二药除均能利尿通淋外，又均能
A. 收敛止血
B. 凉血止血
C. 化瘀止血
D. 益气止血
E. 温经止血

正确答案：B。凉血止血

解析：本题考查的是石韦与白茅根的功效。医师加用石韦与白茅根，里因二药除均能利尿通淋外，又均能凉血止血（B对）。石韦：【功效】利尿通淋，凉血止血，清肺止咳。白茅根：【功效】凉血止血，清热生津，利尿通淋。白及：【功效】收敛止血（A错），消肿生肌。三七：【功效】化瘀止血（C错），活血定痛。艾叶：【功效】温经止血（E错），散寒止痛。功效为益气止血（D错）的中药，2022年考试指南未明确说明。